成立专门的中医药评审组织或者由中医药专家参加评审的是
A. 与中医药有关的评审或者鉴定活动
B. 中医药专业技术职务任职资格评审
C. 获得定点资格的中医医疗机构
D. 非营利性中医医疗机构
E. 中医药人员培训规划

正确答案：B。中医药专业技术职务任职资格评审

解析：《中医药法》规定，开展法律、行政法规规定的与中医药有关的评审、评估、鉴定活动，应当成立中医药评审、评估 鉴定的专门组织或者有中医药专家参加。现行法律、行政法规对医药卫生领域的一些评审、评估、鉴定活动作了规定，具体涉及专业技术职务任职资格（B对）、机构、科研课题的立项等内容（ACDE错）。